将制片用的药料与辅料共置快速搅拌制粒机的容器内，使混合、制软材、分粒与滚圆一次完成的制粒方法称为
A. 挤出制粒法
B. 湿法混合制粒法
C. 喷雾转动制粒法
D. 流化喷雾制粒法
E. 干法制粒法

正确答案：B。湿法混合制粒法